具有支持作用的骨盆底肌肉是
A. 肛提肌
B. 会阴深横肌
C. 尿道括约肌
D. 坐骨海绵体肌
E. 肛门外括约肌

正确答案：A。肛提肌

解析：在骨盆底肌肉中，肛提肌起最重要的支持作用（A对）。会阴深横肌自坐骨结节的内侧面伸展至中心腱处（B错）。尿道括约肌环绕尿道，控制排尿（C错）。坐骨海绵体肌始于坐骨结节内侧，沿坐骨升支及耻骨降支前行，向上止于阴蒂海绵体（D错）。肛门外括约肌为围绕肛门的环形肌束，前端汇合于中心腱（E错）。